消化管壁分为
A. 内膜、中膜、外膜
B. 内膜、中膜、浆膜
C. 内膜、中膜、纤维膜
D. 内皮、肌层、纤维膜
E. 黏膜、黏膜下层、肌层、外膜

正确答案：E。黏膜、黏膜下层、肌层、外膜

解析：消化管壁分为黏膜、黏膜下层、肌层和外膜(E对)。